男，70岁。痰中带血1月余。吸烟10年，40支/天。胸部X线片：右肺门大块影伴右上肺不张。支气管镜见右上肺开口内新生物。该患者肺癌的病理类型最可能是
A. 鳞癌
B. 腺癌
C. 小细胞癌
D. 大细胞癌
E. 腺鳞癌

正确答案：A。鳞癌

解析：老年男性患者，长期吸烟史，痰中带血（提示可能有肺癌），X线片示右肺门大块影伴右上肺不张（提示有支气管阻塞），支气管镜见右上肺开口内新生物（提示肿块位于右上肺开口处），结合患者病史、临床表现和相关检查，该患者最可能的诊断为中心型肺癌，中心型肺癌最常见的病理类型是鳞癌（A对）。小细胞癌（C错）也与吸烟密切相关，老年男性、中心型多见，但该病理类型恶性程度高，进展迅速，淋巴和血行转移早，与该患者临床表现不相符。大细胞癌（D错）、腺癌（B错）多见于周围型肺癌。腺鳞癌（E错）是指既有腺癌成分又有鳞癌成分的肺癌，较少见。